患者眩晕头痛，胸膈痞闷，恶心呕吐，舌苔白腻，脉弦滑，治宜选用
A. 温胆汤
B. 镇肝熄风汤
C. 羚角钩藤汤
D. 天麻钩藤饮
E. 半夏白术天麻汤

正确答案：E。半夏白术天麻汤

解析：由眩晕头痛，胸膈脘痞，恶心呕吐，舌苔白腻，脉弦滑的症状，可辨证为风痰上扰证，治宜化痰息风，健脾除湿，方用半夏白术天麻汤（E对）。温胆汤（A错）的功效是理气化痰，清胆和胃；镇肝熄风汤（B错）功效为镇肝熄风，滋阴潜阳；羚角钩藤汤（C错）功效是凉肝息风，增液舒筋；天麻钩藤饮（D错）功效是平肝熄风，清热活血，补益肝肾。